氮氧化物是多种氮气氧化产物的总称，其中造成严重大气污染的是
A. NO₂和NO₃
B. NO和N₂O
C. NO和NO₂
D. N₂O₃和N₂O₄
E. NO₂和N₂O₅

正确答案：C。NO和NO₂

解析：本题考查造成严重大气污染的氮氧化物。氮氧化物是多种氮气氧化产物的总称，其中造成严重大气污染的是NO和NO₂（C对ABDE错）。NO是一种无色气体，为空气中的重要污染物，其来源主要是汽车尾气中的氮氧化物和工业废气中的氮氧化物。NO反应活性非常强，它可与氧气、水蒸气和空气中的其它物质发生反应，产生大量的酸性物质，从而造成大气污染。NO₂是一种有毒的橙红色气体，主要来源于汽车发动机排放的氮氧化物、冶金行业排放的氮氧化物和火灾排放的氮氧化物，是空气中最主要的污染物之一。它能够与水蒸气及其他气体发生反应，产生大量的酸性物质，对空气质量造成污染。